关于MALT淋巴瘤，描述有误的是
A. 肿瘤由形态多样的大B细胞组成
B. 典型的边缘带B细胞是小到中等细胞，核轻微不规则
C. 在腺体组织中上皮常常受累及破坏，形成所谓的淋巴上皮病变
D. 淋巴上皮病变常伴有上皮细胞嗜碱性变
E. 在与良性淋巴细胞浸润病变鉴别时，证明轻链的单一性（克隆性）非常重要

正确答案：A。肿瘤由形态多样的大B细胞组成

解析：MALT淋巴瘤是一种结外淋巴瘤。肿瘤由形态多样的小B细胞组成。典型的边缘带B细胞是小到中等细胞，核轻微不规则，染色质中等，核仁不明显，近似于中心细胞，胞质相对丰富、淡然。在腺体组织中上皮常常受累及破坏，形成所谓的淋巴上皮病变。淋巴上皮病变是指变形或破坏的上皮内有3个以上的边缘区细胞，常伴有上皮细胞嗜碱性变。在与良性淋巴细胞浸润病变鉴别时，证明轻链的单一性（克隆性）非常重要。掌握“恶性淋巴瘤”知识点。